兼有排精和排尿功能
A. 输精管
B. 射精管
C. 精索
D. 生精小管
E. 男性尿道

正确答案：E。男性尿道

解析：男性尿道（E对）兼有排精和排尿功能。